下列关于牙签的介绍，除外的是
A. 可用于牙龈乳头退缩或牙周治疗后牙间隙增大
B. 用来清洁邻面和根分叉区
C. 木质牙签横断面以正方形为佳
D. 常用的牙签有木质牙签和塑料牙签
E. 塑料牙签可设计成匕首形

正确答案：C。木质牙签横断面以正方形为佳

解析：牙签：在牙龈乳头退缩或牙周治疗后牙间隙增大时，可用牙签来清洁邻面和根分叉区。常用的牙签有木质和塑料的。木质牙签要有足够的硬度和韧性，避免折断；表面要光滑，没有毛刺，以免刺伤牙龈；横断面以扁圆形或三角形为佳。塑料牙签则根据牙间隙和龈乳头的解剖形态，设计成匕首形，尖端和刀口圆钝且薄，易于进入牙间隙。掌握“菌斑控制及提高宿主抵抗力”知识点。